硅肺的特征性病变是
A. 类上皮肉芽肿
B. 胸膜呈斑状增厚
C. 硅肺空洞
D. 硅结节
E. 肺间质纤维化

正确答案：D。硅结节

解析：硅肺的特征性病变是硅结节（D对）和肺组织的弥漫性纤维化。肺硅沉着病简称硅肺（曾称砂肺），是长期吸入含游离二氧化硅粉尘沉着于肺组织所引起的一种常见职业病（P195）。硅肺性空洞（C错）是相邻硅结节融合形成的大的结节状病灶因中央缺血、缺氧发生坏死和液化形成的。胸膜呈斑状增厚（B错）和肺间质弥漫性纤维化（E错）是肺石棉沉着病的病变特点。